根据《关于加快药学服务高质量发展的意见》，对评估后符合要求的慢性病患者可以开具长期处方。一次开具的药品用量最长可用
A. 4周
B. 8周
C. 12周
D. 24周

正确答案：C。12周

解析：本题考查慢性病长期药品处方。根据《关于加快药学服务高质量发展的意见》，对评估后符合要求的慢性病患者可以开具长期处方。一次开具的药品用量最长可用12周（C对）。